有关扪诊牙齿的“功能动度”的说法，下列错误的是
A. 0度：同正常牙
B. 1度：仅一个位有异常动度
C. 2度：两个以上位有异常动度
D. 0度：无异常动度
E. 1度：松动幅度小于2mm

正确答案：E。1度：松动幅度小于2mm

解析：扪诊牙齿的“功能动度”时，用示指同时置于患牙及相邻一正常牙的牙颈和龈缘部，令患者做正中和非正中运动，示指可以感觉出患牙的异常动度：0度：同正常牙，无异常动度；1度：仅一个位有异常动度；2度：两个以上位有异常动度。掌握“牙髓病检查方法及诊断程序”知识点。